女，50岁。右肩部疼痛，不能梳头。查体：右肩三角肌萎缩，肩关节外展、外旋、后伸明显受限。X线片未见骨质疏松，肩峰下钙化。其首选诊断为
A. 粘连性肩关节炎
B. 肩关节结核
C. 肩关节肿瘤
D. 肱骨外上髁炎
E. 风湿性关节炎

正确答案：A。粘连性肩关节炎

解析：女，50岁（粘连性肩关节炎高发人群）。右肩部疼痛，不能梳头（与姿势有关的局限性疼痛）。查体：右肩三角肌萎缩，肩关节外展、外旋、后伸明显受限，综上考虑诊断为粘连性肩关节炎（A对）。肩关节结核（B错）病人常有其他部位结核病史和结核中毒症状。肩关节肿瘤（C错）X线片可见改变。肱骨外上髁炎（D错）又称网球肘，病因常是过劳，主要表现为肘关节外侧的疼痛和压痛。风湿性关节炎（E错）受气候影响较大，表现为对称性、游走性疼痛，并伴有红、肿、热的炎症表现。